经白质前连合交叉形成的是
A. 楔束
B. 红核脊髓束
C. 皮质脊髓束
D. 脊髓丘脑束
E. 无

正确答案：D。脊髓丘脑束

解析：脊髓丘脑束（D对）纤维经白质前连合交叉至对侧时上升或先上升 1 -2 节段后再经白质前连合后上升，楔束（A错）起自同侧第 4 胸节及以上的脊神经节细胞中枢突经后根内侧部进入脊髓，在后索上行，红核脊髓束（B错） 起自中脑红核，纤维交叉至对侧，在脊髓外侧索内下行，皮质脊髓束（C错）起于大脑皮质中央前回和其他 一 些皮质区域，下行至延髓锥体交叉处，大部分纤维交叉至对侧。